健康危险因素的个体评价中，如果评价年龄低于实际年龄，说明
A. 被评价者存在的危险因素低于平均水平
B. 被评价者存在的危险因素高于平均水平
C. 被评价者存在的危险因素等于平均水平
D. 被评价者不存在危险因素
E. 以上都不是

正确答案：A。被评价者存在的危险因素低于平均水平